治疗原发性高血压病痰湿内盛证，应首选
A. 龙胆泻肝汤
B. 天麻钩藤饮
C. 镇肝熄风汤
D. 半夏白术天麻汤
E. 地黄饮子

正确答案：D。半夏白术天麻汤

解析：原发性高血压病痰湿内盛证的机理为脾失健运，津液输布障碍，聚湿成痰，痰湿上扰，蒙蔽清窍，治宜祛痰降浊，方用化痰开窍的半夏白术天麻汤加减（D对）。龙胆泻肝汤（A错）可清泻肝胆实火，清利肝胆湿热，治疗肝胆实火上炎证或肝胆湿热下注证；天麻钩藤饮（B错）功效可平肝潜阳，治疗肝阳上亢证；镇肝熄风汤（C错）可镇肝熄风，治疗肝风上扰证；地黄饮子（E错）功效可以滋肾阴，补肾阳，化痰开窍，用以治疗舌强不能语，足废不能用的喑痱。